逆转录是指
A. 以RNA为模板合成RNA
B. 以DNA合成DNA
C. 以DNA合成RNA
D. 以RNA合成蛋白质
E. 以RNA为模板合成DNA

正确答案：E。以RNA为模板合成DNA

解析：逆转录是指以RNA为模板合成DNA（E对）。以RNA为模板合成RNA（A错）是RNA的复制过程。以DNA为模板合成DNA（B错）是DNA的复制过程。以DNA为模板合成RNA（C错）是指DNA的转录过程。以RNA为模板合成蛋白质（D错）是mRNA的翻译过程。